近海水域的水体富营养化现象称之为
A. 赤潮
B. 水华
C. 水质不良
D. 岸边污染带
E. 生态平衡破坏

正确答案：A。赤潮

解析：本题考查近海水域的水体富营养化现象。当含有大量磷、氮的污水进入湖泊、水库、海湾等缓流水体时，可引起藻类及其他浮游生物迅速繁殖，进而导致水体溶解氧量下降，水质恶化，鱼类及其他生物大量死亡，这种水质状况称为水体富营养化。近海水域的水体富营养化现象称之为赤潮（A对BCDE错）。